窦房结位于
A. 房间隔下部冠状窦口前上方的心内膜深面
B. 右肺上静脉入口处
C. 上腔静脉前方心内膜深面
D. 上腔静脉与右心房交界处的心外膜深面
E. 房间隔上部后份

正确答案：D。上腔静脉与右心房交界处的心外膜深面

解析：上腔静脉与右心房交界处的心外膜深面（D对）有窦房结，多呈长梭形（或半月形）。